生化汤除活血化瘀，止痛外，还具有的功用是
A. 祛风
B. 温经
C. 行气
D. 疏肝
E. 养血

正确答案：B。温经

解析：生化汤功效为养血活血，温经止痛，方中当归补血活血，化瘀生新，川芎活血行气，桃仁活血祛瘀，炮姜温经止血，黄酒温通血脉，整方既能养血又能活血，兼具温经，主治血虚寒凝，瘀血阻滞证（B对）。